流感疫苗接种的重点人群是
A. 12岁及以下儿童
B. 12岁以上人群
C. 小于6个月的婴儿
D. 65岁及以上的人群
E. 医疗卫生机构工作人员

正确答案：D。65岁及以上的人群